胫后动脉经过
A. 内踝前方
B. 内踝后方
C. 外踝前方
D. 外踝后方
E. 内、外踝连线中点

正确答案：B。内踝后方

解析：胫后动脉沿小腿后面浅、深层肌之间下行，经过内踝的后方（B对）转至足底，分为足底内侧动脉和足底外侧动脉两终支。